抽样调查方法中，抽样误差最大的方法是
A. 单纯随机抽样
B. 整群抽样
C. 系统抽样
D. 分层抽样
E. 多阶段抽样

正确答案：B。整群抽样